具有黏滞特性的外感病邪是
A. 风邪
B. 寒邪
C. 湿邪
D. 暑邪
E. 燥邪

正确答案：C。湿邪

解析：本题考查的是湿邪的性质及致病特点。具有黏滞特性的外感病邪是湿邪（C对）。在中医病因学中六淫是最主要的发病因素之一。六淫即风、寒、暑、湿、燥、火六种外感病邪的统称。六淫的性质及治病特点：1.风邪（A错）的性质及致病特点：（1）风为阳邪，其性开泄，易袭阳位；（2）风邪善行而数变；（3）风为百病之长。2.寒邪（B错）的性质及致病特点：（1）寒为阴邪，易伤阳气；（2）寒性凝滞，主痛；（3）寒性收引。3.暑邪（D错）的性质及致病特点：（1）暑为阳邪，其性炎热；（2）暑性升散，耗气伤津；（3）暑多挟湿。4.湿邪的性质及致病特点：（1）湿为阴邪，易阻遏气机，损伤阳气；（2）湿性重浊；（3）湿性黏滞；（4）湿性趋下，易伤阴位。5.燥邪（E错）的性质及致病特点：（1）燥性干涩，易伤津液；（2）燥易伤肺。6.火邪的性质及致病特点：（1）火热为阳邪，其性炎上；（2）火易伤津耗气；（3）火热易生风动血；（4）火热易发肿疡。